经络系统中，具有维持人体正常运动功能的是
A. 十二经脉
B. 十五络脉
C. 十二经别
D. 十二经筋
E. 十二皮部

正确答案：D。十二经筋

解析：十二经脉具有运行全身气血，联络脏腑肢节，沟通表里上下内外，调节体内各部分功能活动的重要作用（A错）。四肢部的十二络脉加强了十二经中表里两经的联系，沟通了表里两经的经气，补充了十二经脉循行的不足。躯干部的任脉别络、督脉别络和脾之大络分别沟通了腹部、背部和全身的经气（B错）。十二经别不仅加强了十二经脉的内外联系，更加强了经脉所属络的脏腑在体腔深部的联系，补充了十二经脉在体内外循行的不足，扩大了经穴的主治范围（C错）。十二经筋具有约束骨骼、屈伸关节、维持人体正常运动功能的作用（D对）。十二皮部起着保卫机体、抗御外邪和反映病证的作用（E错）。